根据《药品流通监督管理办法》，医疗机构的药品购进记录应当
A. 保存3年或以上
B. 保存5年
C. 保存至超过药品有效期1年，但不少于2年
D. 保存至超过药品有效期1年，但不少于3年
E. 保存至超过药品有效期1年，但不少于5年

正确答案：D。保存至超过药品有效期1年，但不少于3年

解析：本题考查的是医疗机构药品购进渠道与质量管理。根据《药品流通监督管理办法》，医疗机构的药品购进记录应当保存至超过药品有效期1年，但不少于3年（D对）。医疗机构应建立真实、完整的药品购进记录。药品购进记录必须注明药品的通用名称、剂型、规格、批号、有效期、生产厂商、供货单位、购货数量、购进价格、购货日期以及国务院药品监督管理部门规定的其他内容。从药品生产企业、药品批发企业采购药品时，供货企业开具的票据应标明供货单位名称、药品名称、生产厂商、批号、数量、价格等内容的销售凭证。对留存的资料和销售凭证和购进（验收）记录等，应当按规定保存至超过药品有效期1年，但不得少于3年。